对绿色涂料特征来说，不确切的是
A. 无毒害
B. 无污染
C. 无放射性
D. 有利于环境保护和人体健康
E. 便宜且实用

正确答案：E。便宜且实用

解析：本题考查绿色涂料的特征。绿色涂料又称环保涂料、健康涂料、生态涂料等，是无毒害（A对）、无污染（B对）、无放射性（C对）、有利于环境保护和人体健康（D对）的涂料。便宜且实用（E错，为本题正确答案）不是绿色涂料的特征。